某医生收集10例某病病人，记录了患者在抢救期间的总胆固醇，用爱丁堡-斯堪的纳维亚神经病学卒中SNSS量表评定患者的神经功能缺损程度，已知量表评分呈偏态分布。若要分析总胆固醇与神经功能评分间的相关性，宜用
A. 积差相关系数
B. 等级相关系数
C. 直线回归系数
D. 决定系数
E. 截距

正确答案：B。等级相关系数